抑制体内环氧酶活性的药物是
A. 氯沙坦
B. 卡托普利
C. 施慧达
D. 雷米替丁
E. 阿司匹林

正确答案：E。阿司匹林

解析：阿司匹林是环氧化酶抑制药（E对），与COX-1的活性部位结合，不可逆的抑制COX-1的活性，发挥抗血小板的活性。氯沙坦（A错）（P224）是血管紧张素受体拮抗剂，通过阻断血管紧张素受体而扩张血管。卡托普利（B错）（P223）是血管紧张素转化酶抑制药，通过抑制血管紧张素Ⅱ的合成发挥扩张血管作用。施慧达（C错）即苯磺酸左旋氨氯地平，是钙拮抗剂，阻滞心肌和血管平滑肌细胞外钙离子经细胞膜的钙离子通道（慢通道）进入细胞而发挥舒张血管作用。雷尼替丁（D错）（P304）为强效组胺H2受体拮抗剂，能有效地抑制组胺、五肽胃泌素和氨甲酰胆碱刺激后引起的胃酸分泌而降低胃酸和胃酶活性。